脾肿大最显著的疾病是
A. 急性粒细胞白血病
B. 急性淋巴细胞白血
C. 急性单核细胞白血病
D. 慢性粒细胞白血病
E. 慢性淋巴细胞白血病

正确答案：D。慢性粒细胞白血病

解析：脾肿大最显著的疾病是慢性粒细胞白血病（D对），往往就医时已达或超过脐部。急性粒细胞白血病（P571）（A错）、急性淋巴细胞白血（P571）（B错）、急性单核细胞白血病（P571）（C错）和慢性淋巴细胞白血病（P580）（E错）脾肿大多为轻至中度，巨脾罕见。